急性肾损伤患者出现原尿回漏的原因是
A. 肾小球滤过率降低
B. 肾间质水肿挤压肾小管
C. 肾小球滤过分数低
D. 肾小管上皮细胞坏死、脱落
E. 肾小管的水钠重吸收减弱

正确答案：D。肾小管上皮细胞坏死、脱落

解析：肾小管上皮细胞在持续肾缺血和肾毒物的作用下，经过受损的肾小管壁处，原尿会返漏入周围肾间质，除直接引起尿量减少，还可引起肾间质水肿，使肾小管受压，引起囊内压升高，GFR减少，出现少尿（D对）。